小儿结核性脑膜炎的诊断，最重要的辅助检查是
A. 脑电图
B. 头颅B超
C. 血沉
D. 结核抗体
E. 脑脊液检查

正确答案：E。脑脊液检查